用于治疗疱疹的药物是
A. 恩替卡韦
B. 伐昔洛韦
C. 索磷布韦
D. 利托那韦
E. 奥司他韦

正确答案：B。伐昔洛韦

解析：本题考查抗疱疹病毒药。抗疱疹病毒药包括核苷类和非核苷类，伐昔洛韦（B对）属于核苷类抗疱疹病毒药物。